对抑郁症的处理措施中最首要的是
A. 改善情绪状态
B. 加强心理治疗
C. 改善营养
D. 改善睡眠状况
E. 评估自杀风险

正确答案：E。评估自杀风险

解析：抑郁障碍的治疗包括药物治疗、心理治疗和物理治疗（包括无抽搐治疗和休克治疗）。首要措施是采用HAMD-17（汉密尔顿抑郁量表）或MADRS（蒙哥马利抑郁量表）评估自杀风险（E对）。